心脏扩张不伴收缩增强，称为
A. 紧张性扩张
B. 肌源性扩张
C. 向心性肥大
D. 心室僵硬度
E. 心肌重构

正确答案：B。肌源性扩张

解析：长期前负荷过重时，心脏扩张，使心肌肌节长度超过2.2μm（产生最大收缩力时的肌节长度）时，粗细肌丝不能充分重叠，有效横桥的数目减少，心肌收缩力降低，这种心脏扩张不伴收缩增强的情况称为肌源性扩张（B对）。若心脏处于代偿期，心肌肌节长度小于2.2μm，这时可出现心脏扩张伴收缩增强，称为紧张性扩张（A错）。